竞争性拮抗H₂受体，抑制胃酸分泌的药物是
A. 奥美拉唑
B. 雷尼替丁
C. 特布他林
D. 氯苯那敏
E. 沙丁胺醇

正确答案：B。雷尼替丁